社会医学研究的特点是
A. 研究对象的复杂性和社会群体性
B. 研究方法的综合性和跨学科性
C. 研究内容的广泛性
D. 研究结果的实践性和现实指导性
E. 以上都是

正确答案：E。以上都是